牙折常发生于下述哪个区域
A. 下前牙区
B. 上前牙区
C. 尖牙
D. 前磨牙区
E. 磨牙区

正确答案：B。上前牙区

解析：牙槽突骨折常是外力（如碰撞）直接作用于牙槽突所致，多见于上颌前部，可以单独发生，也可与颌面部其他损伤同时发生，可以是线形也可是粉碎性骨折。临床上，牙槽突骨折常伴有唇和牙龈的肿胀、撕裂、牙松动、牙折或牙脱落。掌握“牙槽突骨折、颌骨骨折”知识点。